诊断早期股骨头坏死最敏感的检查是
A. B超
B. MRI
C. 血管造影
D. CT
E. X线

正确答案：B。MRI

解析：诊断早期股骨头坏死最敏感的检查是MRI（B对）。MRI在股骨头缺血坏死早期便可发现骨质的改变，股骨头前上部在T1WI呈条带状低信号，在T2WI显示出典型的双线征。X线（E错）也是股骨头坏死诊断的重要手段，股骨头血液供应中断后12小时骨细胞便可出现坏死，但是在X线片上看股骨头密度改变至少需要8周或更长的时间。CT（D错）虽然显示骨坏死较X线敏感，但不如MRI敏感。B超（A错）无法穿透成人皮质骨，故难于诊断骨骼疾病。血管造影（C错）可显示股骨头供血血管的相关情况，而不能发现骨质改变，故一般不作为股骨头坏死的诊断手段。